镇痛作用比吗啡强的药物有
A. 盐酸纳洛酮
B. 盐酸哌替啶
C. 右丙氧芬
D. 枸橼酸芬太尼
E. 盐酸美沙酮

正确答案：D、E。枸橼酸芬太尼；盐酸美沙酮

解析：本题考查哌替啶类镇痛药。镇痛作用比吗啡强的药物有枸橼酸芬太尼（D对）、盐酸美沙酮（E对）。枸橼酸芬太尼亲脂性高，易于通过血-脑屏障，起效快，作用强，镇痛作用为哌替啶的500倍，吗啡的80～100倍。盐酸美沙酮镇痛作用比吗啡、哌替啶稍强，成瘾性等副作用也相对较小，适用于各种原因引起的剧痛。纳洛酮（A错）为阿片受体拮抗剂，临床上可用于服用吗啡或海洛因中毒的成瘾者的解救。哌替啶（B错）的镇痛作用为吗啡的1/8～1/6，且成瘾性弱于吗啡。右丙氧芬（C错）主要与阿片μ受体结合，其作用与美沙酮相似，镇痛作用较弱，仅能用于缓解轻度到中度疼痛。几乎无镇咳作用。